NK细胞通过ADCC作用杀伤靶细胞需要
A. 补体
B. 抗体
C. 细胞因子
D. MHC分子
E. TCR

正确答案：B。抗体